男性，13岁，因发热，头痛，皮疹2天入院。入院检查：急性病容，皮疹出现于躯干、头面部、四肢近端。可见红斑疹、皮疹、疱疹、脓疱疹不同形态的皮疹，个别皮疹已结痂，血象：白细胞总数为0.8×10⁹/L，患儿同学中有类似的病人，本病患者最可能的诊断是
A. 水痘
B. 带状疱疹
C. 麻疹
D. 丘疹样荨麻疹
E. 风疹

正确答案：A。水痘